患者，男，14岁，上下牙列釉质发育不全，此时前牙首选治疗方案是
A. 烤瓷冠
B. 可见光固化树脂贴面
C. 前牙3/4冠
D. 金-塑混合全冠
E. 树脂全冠

正确答案：B。可见光固化树脂贴面

解析：本题考查牙体缺损修复体固位及适应、禁忌证。可见光固化树脂贴面（B对）是由树脂按照牙体外形形成贴面后，通过光固化作用使树脂固化于牙体表面，主要用于前牙修复。只覆盖前牙唇面，磨除牙体少。全冠修复一般建议18岁后进行。即使可行全冠修复全瓷冠或烤瓷冠的修复效果远优于硬树脂冠。